下列最常表现为吸气性呼吸困难的疾病是
A. 胸腔积液
B. 支气管哮喘
C. 气管肿物
D. 慢性阻塞性肺疾病
E. 自发性气胸

正确答案：C。气管肿物

解析：吸气性呼气困难主要见于喉部、气管、大支气管阻塞与狭窄，如气管肿物（C对）等。胸腔积液（A错）和自发性气胸（E错）时，患者表现为混合性呼吸困难，支气管哮喘（B错）和COPD（慢性阻塞性肺疾病）（D错），患者表现为呼气性呼吸困难。